乳牙牙震荡在术后复查的时机说法正确的是
A. 术后4周、3个月，6个月
B. 术后1个月，6个月、12个月
C. 术后3个月、6个月、9个月
D. 术后6个月，12个月
E. 不必复查

正确答案：A。术后4周、3个月，6个月

解析：乳牙牙齿震荡和牙脱位常常不做临床治疗，嘱患儿避免咬硬物2周。同时注意维护口腔健康，避免牙龈炎症。一般在术后4周、3个月、6个月复查，如果发现牙髓感染的症状，应及时行牙髓摘除术。掌握“牙外伤概述及乳牙外伤”知识点。